在DNA复制中RNA引物的功能（作用）是
A. 使DNA聚合酶活化并使DNA双链解开
B. 提供5′末端作为合成新DNA链的起点
C. 提供5′末端作为合成新RNA链的起点
D. 提供3′-OH末端作为合成新DNA链的起点
E. 提供3′-OH末端作为合成新RNA链的起点

正确答案：D。提供3′-OH末端作为合成新DNA链的起点

解析：在DNA复制中RNA引物的功能（作用）是提供3＇-OH末端作为合成新DNA链的起点（D对BCE错）。原核生物DNA的解链过程是由DnaA、DnaB、DnaC三种蛋白质共同参与完成；真核生物DNA的解链过程和具有解螺旋酶活性的DNA pol Ⅲ的δ亚基有关，和RNA引物无关（A错）。